关于避孕方法，下列哪项最不可靠
A. 宫内节育器
B. 口服避孕药
C. 安全期避孕
D. 阴道隔膜
E. 避孕套

正确答案：C。安全期避孕

解析：本题考查避孕方法。体外排精和安全期避孕（C错，为本题正确答案）不可靠，不宜使用。避孕方法有：短期避孕宜选用短效的避孕方法如避孕套（E对）和复方短效口服避孕药（B对）；较长时间不打算生育且性生活较规律者，可以考虑长效的避孕方法如皮下埋植剂和宫内节育器（A对）。阴道隔膜（D对）是一柔软的乳胶杯，其周边有一坚韧、可变形的圈弹簧，性交时放置在阴道适当位置，阻隔精子和宫颈接触，起到屏障作用。阴道避孕栓／胶冻／药膜的避孕效果较差，而且使用不方便，不宜使用；长效口服避孕药和避孕针在停用后不能立即受孕，也不宜使用。